急性白血病主要死亡原因是
A. 严重感染
B. 免疫功能低下
C. 出血、特别是颅内出血
D. 贫血
E. 疼痛

正确答案：C。出血、特别是颅内出血

解析：急性白血病以出血早期表现者近40%，出血可发生在全身各部位，以皮肤瘀点、瘀斑、鼻出血、牙龈出血、月经过多为多见，有资料表明AL死于出血者占62.24%，其中87%为颅内出血（C对）。急性白细胞严重感染可致菌血症及败血症（A错），是最常见的死亡原因。免疫功能低下（B错）可出现在急性白血病患者中，但不是主要死因；急性白血病部分患者因病程短，可无贫血（D错）；急性白血病可有胸骨下段局部压痛（E错），不属于死亡原因。